可作为水溶性药物的包合材料，达到缓释效果的辅料是
A. 明胶
B. 乙基-β-CYD
C. PEG类
D. HPMC
E. 羟丙基-β-CYD

正确答案：B。乙基-β-CYD

解析：本题考查包合材料。疏水性环糊精衍生物常用作水溶性药物的包合材料，以降低水溶性药物的溶解度，使具有缓释性。乙基-β-CYD（B对）微溶于水，比β-CYD的吸湿性小，具有表面活性，在酸性条件下比β-CYD更稳定。明胶（A错）可作为微囊的载体材料。PEG类（C错）可作为难溶性药物固体分散剂载体材料。可作为HPMC（D错）（羟甲基纤维素）可作为薄膜包衣材料。羟丙基-β-CYD（E错）为水溶性环糊精衍生物，包合后可提高难溶性药物的溶解度，促进药物的吸收。